盘状红斑狼疮在口腔黏膜中的好发部位最常见的是
A. 颊部
B. 软腭
C. 舌背
D. 上唇唇红
E. 下唇唇红

正确答案：E。下唇唇红

解析：本题考查盘状红斑狼疮在口腔黏膜中的好发部位。盘状红斑狼疮（DLE）是一种慢性皮肤黏膜结缔组织疾病，病损特点为持久性红斑，中央萎缩凹下呈盘状。下唇唇红（E对）黏膜是DLE的好发部位，另外良性淋巴组织增生性唇炎也多见于下唇唇红部，尤以下唇正中部为好发区。口腔扁平苔藓（OLP）病损大多左右对称，可发生在口腔黏膜的任何部位，但以颊部（A错）最为多见。地图舌好发于舌背（C错）、舌尖、舌缘部，有时伴有腭、颊粘膜以及牙龈相似的病损。疱疹性咽峡炎好发于软腭（B错）。唇疱疹好发于上下唇（D错）。